内釉上皮诱导牙乳头细胞分化为成牙本质细胞是成釉器的哪期
A. 帽状期
B. 钟状期
C. 蕾状期
D. 牙萌出期
E. 牙根形成时期

正确答案：B。钟状期

解析：钟状期时，在内釉上皮的诱导下，牙乳头中与内釉上皮接近的细胞分化为成牙本质细胞。掌握“牙胚的发生及分化”知识点。